以下不是产生偏倚的因素的是
A. 调查员
B. 调查对象
C. 调查内容
D. 调查环境
E. 调查样本量大小

正确答案：E。调查样本量大小

解析：调查样本量大小影响抽样，由于抽样所造成的误差属于随机误差，不属于偏倚的范畴。